P₂大于A₂
A. 肺栓塞
B. 肺炎
C. 肺结核
D. 主动脉夹层
E. 胸腔积液

正确答案：A。肺栓塞

解析：P₂>A₂即肺动脉瓣区第二心音亢进，是肺栓塞的循环系统体征（A对）。